能直接作用于体温调节中枢的物质是
A. 白细胞致热源
B. 细菌毒素
C. 抗原抗体复合物
D. 坏死物质
E. 病毒

正确答案：A。白细胞致热源

解析：下丘脑视前区-下丘脑前部（PO/AH）是机体最重要的体温调节中枢，PO/AH的温度敏感神经元还接受多种物质的刺激，包括致热原、5-羟色胺、去甲肾上腺素和多种肽类物质。各种病原体、细菌、细菌内毒素（B错）、抗原-抗体复合物（C错）、坏死物质（D错）、病毒（E错）等，称为外生性致热源。目前认为这些致热源作用于血液中的中性粒细胞和大单核细胞，使其被激活而生成和释放出白细胞致热源（A对），通过血液循环作用于体温调节中枢而改变其功能状态，从而影响产热和散热过程，使产热增加，散热降低，引起体温上升，出现发热反应。